属于Ⅱ型超敏反应导致的疾病是
A. 接触性皮炎
B. 新生儿溶血病
C. 支气管哮喘
D. 荨麻疹
E. 链球菌感染后肾小球肾炎

正确答案：B。新生儿溶血病

解析：Ⅱ型超敏反应又称为细胞型或细胞毒型超敏反应，是由IgG或IgM抗体与靶细胞表面相应抗原结合后，在补体、吞噬细胞和NK细胞参与下，引起的以细胞溶解或组织损伤为主的病理免疫反应。与Ⅱ型超敏反应有关的疾病有输血反应、新生儿溶血病（B对）、药物过敏性血细胞减少症等。接触性皮炎属于Ⅳ型超敏反应（A错）。支气管哮喘、荨麻疹属于I型超敏反应（CD错）。链球菌感染后肾小球肾炎属于III型超敏反应（E错）。